女性，45岁，因左侧面颊部皮肤及左侧舌部黏膜发红、起疱3天，伴剧痛来诊。查体：体温38.5℃，左侧面部皮肤及左侧舌背、颊黏膜可见粟粒大小的密集成片的透明水疱，周围皮肤黏膜可见充血性红斑。化验：WBC7.8×19/L，中性62%，淋巴34%。拟诊断为带状疱疹。本病例主要病变部位在三叉神经第2支。带状疱疹与单纯疱疹的最主要鉴别点在于临床表现不同。本病例可发生的最严重的并发症为
A. 肺炎
B. 脑炎
C. 结膜炎
D. 角膜炎
E. 面瘫

正确答案：E。面瘫

解析：本题考查带状疱疹可发生的最严重的并发症。当带状疱疹病毒入侵膝状神经节可出现外耳道或鼓膜疱疹，带状疱疹膝状神经节受累同时侵犯面神经的运动和感觉神经纤维时，表现为面瘫（E对）、耳痛及外耳道疱疹三联征，面瘫是最严重的并发症。当病毒入侵三叉神经第一支时，可累及眼角黏膜，出现结膜炎（C错）和角膜炎（D错）等，相较于面瘫症状较轻，容易治疗，不是其最严重的并发症。带状疱疹最常见的为腰腹部疱疹，约占整个病变的百分之七十，其次为三叉神经带状疱疹，约占百分之二十，病损沿三叉神经分布，一般不会引发肺炎（A错）、脑炎（B错）等。